肾细胞癌最常见的病理类型是
A. 透明细胞癌
B. 乳头状肾细胞癌
C. 未分类肾细胞癌
D. 嫌色细胞癌
E. 集合管癌

正确答案：A。透明细胞癌

解析：肾细胞癌又称肾腺癌，简称为肾癌，肾癌的组织病理多种多样，透明细胞癌（A对）是最常见的病理类型，占肾癌的70%～80%，主要由肾小管上皮细胞发生。（八版病理学P280）乳头状肾细胞癌（B错）占肾细胞癌的10%～15%；嫌色性肾细胞癌（D错）占肾细胞癌的5%左右；集合管癌（E错）在肾细胞癌中比例不到1%；未分类肾细胞癌（C错）为不能归入其他类型的肾细胞癌，约占3%～5%。